2020年1月31日，药品零售企业甲从药品批发企业乙购进药品上市许可持有人丙生产的中药注射剂Z。在验收入库时核对验明票、货、账三者一致后入库销售。中药注射制剂Z说明书标注标注“有效期24个月”，标签标注“生产日期为2019年7月1日，有效期至2021年6月”。2020年6月甲所在地突降暴雨，中药注射剂Z被雨水浸泡导致药品标签剥落或字迹模糊。2020年7月甲将该批药品中的三盒销售给某患者销售总价为200元。该患者用药后病情加重。关于甲采购Z的行为，符合规定的是
A. Z说明书中标注的有效期格式“有效期至2021年6月”有误，应该退回
B. 采购时仅向配送药品的乙索要、核对验证发票即可
C. 作为药品零售企业，甲不能购进中药注射剂
D. 购进票据保存期不得少于5年，至少保存至2025年2月1日

正确答案：D。购进票据保存期不得少于5年，至少保存至2025年2月1日

解析：本题考查的是零售企业药品收货与验收。2020年1月31日，药品零售企业甲从药品批发企业乙购进药品上市许可持有人丙生产的中药注射剂Z。在验收入库时核对验明票、货、账三者一致后入库销售。中药注射制剂Z说明书标注标注“有效期24个月”，标签标注“生产日期为2019年7月1日，有效期至2021年6月”。2020年6月甲所在地突降暴雨，中药注射剂Z被雨水浸泡导致药品标签剥落或字迹模糊。2020年7月甲将该批药品中的三盒销售给某患者销售总价为200元。该患者用药后病情加重。关于甲采购Z的行为，符合规定的是购进票据保存期不得少于5年，至少保存至2025年2月1日（D对）。药品批发企业药品经营活动：药品批发企业购进药品，应当建立并执行进货检查验收制度，索取、查验、留存《药品经营监督管理办法》规定的供货企业及其授权委托销售人员有关证件资料、销售凭证（保存至超过药品有效期1年，且不得少于5年），在验明药品合格证明和其他标识等证明药品合法性材料后方可购进、销售；不符合规定的，不得购进和销售。药品标签上药品有效期的规定：药品标签中的有效期应当按照年、月、日的顺序标注，年份用四位数字表示，月、日各用两位数表示。其具体标注格式为“有效期至××××年××月”（A错）或者“有效期至××××年××月××日”；也可以用数字和其他符号表示为“有效期至××××.××.”或者“有效期至××××/××/××”等。预防用生物制品有效期的标注按照国家药品监督管理部门批准的注册标准执行，治疗用生物制品有效期的标注应自分装日期计算，其他药品有效期的标注以生产日期计算。有效期若标注到日，应当为起算日期对应年月日的前一天；若标注到月，应当为起算月份对应年月的前一月。如果由于包装尺寸或者技术设备等原因有效期确难以标注为“有效期至某年某月”的，可以标注有效期实际期限，如“有效期24个月”。零售企业收货与验收：药品到货时，收货人员应当按采购记录，对照供货单位的随货同行单（票）核实药品实勿，做到票、账、货相符。企业应当按规定的程序和要求对到货药品逐批进行验收，查验药品检验报告书并做好验收记录。验收抽取的样品应当具有代表性（B错）。根据《关于做好处方药与非处方药分类管理实施工作的通知》（国食药监安〔2005〕409号）的规定，对于部分滥用或超剂量使用会带来较大的安全性风险的药品，药品零售企业必须做到严格凭处方销售。此类药品包括所有注射剂（C错）、医疗用毒性药品、第二类精神药品、禁止零售的药品以外其他按兴奋剂管理的药品、精神障碍治疗药（抗精神病、抗焦虑、抗躁狂、抗抑郁药）、抗病毒药（逆转录酶抑制剂和蛋白酶抑制剂）、肿瘤治疗药、含麻醉药品的复方口服溶液和曲马多制剂、未列入非处方药目录的抗菌药物和激素，以及国家药品监督管理局公布的其他必须凭处方销售的药品。药品零售企业对疑似假冒或不合法处方，除拒绝调配外，还应当向所在地药品监督管理部门报告。